某雄黄矿工人，工龄20年。近来被确诊为肺癌。其接触的致癌物可能是
A. 铅
B. 砷
C. 铬
D. 锰
E. 镍

正确答案：B。砷

解析：本题考查砷导致的肺癌。无机砷（B对ACDE错）化合物是人类皮肤癌和肺癌的致癌物。题中的工人长期接触雄黄矿，雄黄矿中的砷会导致工人患肺癌。